普萘洛尔属于
A. 选择性β₁受体激动药
B. 非选择性β受体阻断药
C. 选择性α受体阻断药
D. 非选择性α受体阻断药
E. α、β受体阻断药

正确答案：B。非选择性β受体阻断药

解析：本题考查普萘洛尔。普萘洛尔属于非选择性β受体阻断剂（B对）。普萘洛尔属于非选择性β受体阻断剂，具有较强的β受体拮抗作用，主要治疗高血压、心绞痛和心律失常及甲状腺功能亢进等。选择性β₁受体激动药（A错）有多巴酚丁胺等。选择性α受体阻断药（C错）有哌唑嗪、特拉唑嗪等。非选择性α受体阻断药（D错）酚妥拉明、妥拉唑林等。α、β受体阻断药（E错）有拉贝洛尔等。